含有3羟基-内酯环结构片段，需要在体内水解成3，5-二羟基戊酸，才能发挥作用的HMG-CoA还原酶抑制剂是
A. 辛伐他汀
B. 氟伐他汀
C. 普伐他汀
D. 西立伐他汀
E. 阿托伐他汀

正确答案：A。辛伐他汀

解析：本题考查他汀类药物的结构。含有3羟基-内酯环结构片段，需要在体内水解成3，5-二羟基戊酸，才能发挥作用的HMG-CoA还原酶抑制剂是辛伐他汀（A对BCDE错）。